以下哪项不属于十二经筋的分布特点
A. 起始于四肢末端
B. 结聚于关节骨骼部
C. 走向躯干头面
D. 约束骨骼，屈伸关节
E. 行于体表，入于内脏

正确答案：E。行于体表，入于内脏

解析：十二经筋的循行分布，与其所辖经脉体表通路基本一致，其循行走向均从四肢末端走向头身第（AC对），行于体表，不入内脏（E错，为本题正确答案）。其分布是成片的，有结、聚、散、络的特点。结聚部位多在关节（B对）及肌肉丰厚处，并与邻近的他经相联结。其中足三阳经筋起于足趾，循股外上行结于面部；足三阴经筋起于足趾，循股内上行结于阴器（腹部）；手三阳经筋起于手指，循臑外上行结于角（头部）；手三阴经筋起于手指，循臑内上行结于贲（胸部）。前阴是宗筋所聚，足三阴与足阳明经筋都在该处聚合。散，主要在胸腹。络，足厥阴肝经除结于阴器外，还能总络诸筋。此外，经筋还有刚（阳）筋、柔（阴）筋之分，刚筋分布于项背和四肢外侧，以手足阳经经筋为主；柔筋分布于胸腹和四肢内侧，以手足阴经经筋为主。经筋的作用主要是约束骨骼，利于关节屈伸活动（D对）。